男，42岁。5个月前咳嗽，咳黄脓痰，经检查诊断为“右下肺脓肿”。现住院治疗4月余，仍间断咯血、发热，复查胸部X线片示右下肺可见空洞、内有液平。此时，应采取的最佳治疗是
A. 经皮穿刺引流
B. 祛痰及体位引流
C. 纤支镜冲洗、引流
D. 手术切除病变组织
E. 继续抗感染治疗

正确答案：D。手术切除病变组织

解析：患者右下肺脓肿，经治疗4月余仍间断咯血、发热，复查胸部X线片示右下肺可见空洞、内有液平（为肺脓肿的典型胸片改变），考虑诊断为肺脓肿，且内科治疗无效，脓腔不缩小，此为手术切除肺脓肿病变组织的治疗适应症（D对）。经皮穿刺引流（A错）、祛痰及体位引流（B错）、纤支镜冲洗引流（C错）均为脓液引流的方法，是病情可控、患者身体耐受的情况下的肺脓肿治疗方法（P60）。抗感染治疗（E错）为肺脓肿病程较短时的首选治疗方法，疗程为6～8周，该患者病程较长，已4个月，故不适宜此方法。